32岁，外阴瘙痒伴分泌物多4~5天，妇科检查：阴道黏膜散在红色斑点，阴道内多量脓性泡沫状分泌物，有臭味。对此病人进行检查时，不正确操作是
A. 取分泌物前不能做双合诊
B. 取分泌物前先行碱性液体冲洗
C. 取分泌物行悬滴法检查
D. 可疑病人多次悬滴法阴性时做培养
E. 检查标本应注意保暖

正确答案：B。取分泌物前先行碱性液体冲洗

解析：中青年女性，外阴瘙痒伴分泌物多4～5天，妇科检查：阴道黏膜散在红色斑点（滴虫阴道炎典型体征），阴道内多量脓性泡沫状分泌物（滴虫阴道炎分泌物的典型特点），有臭味，根据患者的症状及体征，考虑最可能的诊断为滴虫阴道炎，对此病人进行检查时，不正确操作是取分泌物前先行碱性液体冲洗（B错，为本题正确答案），取分泌物前1-2天不能进行阴道阴道灌洗或局部用药，不能做双合诊（A对），检查标本应注意保暖（E对），取分泌物行悬滴法检查（C对），可疑病人多次悬滴法阴性时做培养（D对）。